Kennedy一类牙列缺损，采用混合支持式义齿设计时，末端基牙使用应力中断式卡环的主要目的是
A. 增加义齿固位力
B. 增强义齿稳定
C. 有利于将载荷更均匀地分散到基牙和牙槽嵴上
D. 防止牙槽嵴黏膜压痛
E. 减轻牙槽嵴负担

正确答案：C。有利于将载荷更均匀地分散到基牙和牙槽嵴上

解析：本题考查回力卡环的应力中断作用。应力中断式卡环如回力卡环，由于远中支托不与基托或连接杆直接相连，力通过人工牙和基托首先传至基托下组织上，可减轻基牙承受的力，有利于将载荷更均匀地分散到基牙和牙槽嵴上（C对）。卡环的卡环臂尖位于倒凹区，是卡环产生固位作用的主要部分，可适当增加义齿固位力（A错）。卡环臂起始部分较坚硬，放置在非倒凹区，起稳定作用，增加义齿稳定（B错），但这些并不是应力中断式卡环的主要目的。卡环的支点与转动半径有关，支点前移会使游离距延长，在相同力作用下，基牙受力减少，但基托下黏膜和牙槽骨组织受力增加，会导致牙槽嵴黏膜压痛、增加牙槽嵴负担，因此防止牙槽黏膜压痛（D错）、减轻牙槽嵴负担（E错）也不是应力中断式卡环在末端基牙使用时的主要目的。